次生环境是指
A. 无机物所形成的环境
B. 有机物所形成的环境
C. 由于人类活动（生产和生活）所形成的环境
D. 天然形成的环境
E. 某些元素分布不均所造成的环境

正确答案：C。由于人类活动（生产和生活）所形成的环境

解析：本题考查次生环境。次生环境是指由于人类活动（生产和生活）所形成的环境（C对ABDE错），它是一种特殊的环境，是人类活动对自然环境的影响和改变所造成的环境。